某72岁的老年女性慢性支气管炎患者，既往有吸烟史，当前用药包括异丙托溴铵气雾剂和沙丁胺醇。十一国庆假期结束后，她到社区卫生服务中心常规取药。作为一名社区医生，本次接诊过程中可以提供给该名患者的第一级预防建议为
A. 指导患者用药方法
B. 指导患者进行呼吸训练
C. 建议患者接受肺功能检查
D. 鼓励患者接种流感疫苗
E. 鼓励患者定期接受结肠镜检查

正确答案：D。鼓励患者接种流感疫苗